男，40岁。腹泻1天，约20多次，“米泔水样”便，继之呕吐数次，无明显发热及腹痛。查体：T36℃，P120次/分，BP60/40mmHg，意识模糊，重度脱水貌，腹软，无压痛，肠鸣音活跃。实验室检查：粪镜检未见白细胞，悬滴法观察粪便中细菌穿梭样运动，碱性蛋白胨水培养有细菌生长。引起本病的病原体是
A. 弯曲菌
B. 霍乱弧菌
C. 志贺菌
D. 大肠埃希菌
E. 沙门菌

正确答案：B。霍乱弧菌

解析：患者腹泻和呕吐，排出“米泔水”样粪便，悬滴法观察细菌呈穿梭样运动，碱性蛋白胨水培养有细菌生长。引起本病的病原体是霍乱弧菌（B对）。